有关胸腺的叙述，正确的是
A. 既是内分泌腺,又是淋巴器官
B. 位于中纵隔内
C. 位于前纵隔和中纵隔内
D. 随年龄的增大而增大
E. 婴幼儿时体积最小

正确答案：A。既是内分泌腺,又是淋巴器官

解析：胸腺既是内分泌器官又是淋巴器官（A对）。胸腺位于上纵隔（BC错）。幼儿和新生儿的胸腺较大（E错），性成熟时发育至高峰，而后逐渐萎缩（D错）。